医师在医疗活动中对病人和社会履行义务的道德责任感和自我评价能力，谓之医师的
A. 爱心
B. 诚心
C. 良心
D. 善心
E. 同情心

正确答案：C。良心

解析：医德良心（C对）是指医务人员在履行医德义务过程中所形成的一种道德意识，是其医德认识、情感、意志的有机统一，其中的核心要素是对所负医德责任的自我感知能力和对医德行为的自我评价能力。